会干扰乙醇代谢过程导致双硫仑样反应，用药期间不宜饮酒的药物是
A. 对乙酰氨基酚
B. 阿奇霉素
C. 阿司匹林
D. 甲硝唑
E. 伊曲康唑

正确答案：D。甲硝唑

解析：本题考查服用期间不宜饮酒的药物。甲硝唑（D对）可干扰酒精的氧化过程，引起体内乙醛蓄积，导致双硫仑样反应。伊曲康唑（E错）用于真菌感染，不会产生“双硫仑样反应”。对乙酰氨基酚（A错）大剂量对肝脏有损，可作为退热药首选。阿奇霉素（B错）的不良反应主要是胃肠道反应。阿司匹林（C错）对缓解轻度或中度疼痛，如牙痛、头痛、神经痛及痛经效果较好，亦用于感冒、流感等发热疾病的退热等。